某病患病率是指
A. 发病总人数/同期平均人口数
B. 某病新旧病例数/同期平均人口数
C. 某病患病人数/年平均人口数
D. 某病发病例数/同期暴露人口数

正确答案：B。某病新旧病例数/同期平均人口数

解析：本题考查患病率的计算。患病率也称现患率，是指某特定时间内总人口中某病新旧病例所占的比例，其计算公式为某观察期间某人群中某病的新旧病例数/同期的平均人口数（B对ACD错）。